氟吸收的主要场所
A. 心
B. 肝
C. 脾
D. 肺
E. 胃、肠道

正确答案：E。胃、肠道

解析：氟吸收是一个简单扩散过程。氟在胃、肠道均可被吸收。氟在胃部吸收机制与胃的酸度有关。掌握“人体氟摄入及代谢、氟防龋”知识点。